正常青年人胸部不会出现的叩诊音是
A. 清音
B. 浊音
C. 实音
D. 鼓音
E. 过清音

正确答案：E。过清音

解析：正常胸部叩诊音为清音（A对）。心脏叩诊为浊音（B对）。胸骨、肋骨、肩胛骨、锁骨叩诊实音（C对）。胃泡区叩诊鼓音（D对）。过清音（E错，为本题正确答案）主要见于肺组织含气量增多的病变如慢性阻塞性肺病，不会见于正常人。